0.01mU/L.临床诊断为甲状腺功能亢进症。适宜的治疗方案为
A. 终止妊娠，选用丙硫氧嘧啶治疗
B. 维持妊娠，行甲状腺切除手术
C. 维持妊娠，选用甲巯咪唑治疗
D. 维持妊娠，选用丙硫氧嘧啶治疗
E. 维持妊娠，加131I治疗

正确答案：D。维持妊娠，选用丙硫氧嘧啶治疗

解析：本题考查妊娠伴甲亢的治疗方案。丙硫氧嘧啶（D对）为妊娠期妇女甲亢首选药。妊娠期用药甲硫咪唑、丙硫氧嘧啶等可透过胎盘，甲硫咪唑（C错）有新生儿皮肤缺损的致畸作用报道，故妊娠期妇女甲亢首选丙硫氧嘧啶（A错）。放射性¹³¹I（E错）禁用于妊娠期、哺乳期妇女。甲状腺次全切术（B错）用于中、重度甲亢，长期服药无效者。